连接“肺主呼吸”和“心主血脉”的中心环节是
A. 经脉的相互连接
B. 气血的相互关系
C. 宗气的贯通和运行
D. 心主营、肺主卫相互作用
E. 以上都不是

正确答案：C。宗气的贯通和运行

解析：宗气具有贯心脉行血气、走息道行呼吸的生理机能，从而加强了血液运行与呼吸之间的联系，成为连接心、肺的中心环节（C对ABDE错）。